组织器官的生长模式不属于一般型的是
A. 胸腺
B. 心脏
C. 胰腺
D. 肠
E. 肺

正确答案：A。胸腺

解析：本题考查生长发育模式的相关内容。胸腺（A错，为本题正确答案）属于淋巴系统型，不属于一般型。人体各组织器官的生长模式可归纳为4类，分别是一般型、神经系统型、淋巴系统型和生殖系统型。1.一般型包括全身肌肉、骨骼、脏器和血液，其生长模式大致与形态指标（身高、体重等）相同，生长期内具有两个突增高峰；2.神经系统型：脑、脊髓、视觉器官以及反映大脑大小的头围、头径等。出生时已达成人的25%，6岁时已达1200g，达到成人脑重的90%；3.淋巴系统型：胸腺、淋巴结、间质性淋巴组织等在出生后头10年生长非常迅速，12岁左右约达成人的200%，在第二个10年期间；4.生殖系统型：在童年期几乎没有发展，只在生长发育第二个突增期开始以后，才开始生长，并通过分泌性激素来促进全面发展和成熟。